在高危人群中进行HIV抗体的筛检属于
A. 一级预防
B. 二级预防
C. 三级预防
D. 常规报告
E. 哨点监测

正确答案：E。哨点监测

解析：本题考查哨点监测。哨点监测是为了更清楚地了解某些疾病在不同地区、不同人群的分布以及相应的影响因素等，根据被监测疾病的流行特点，选择若干有代表性的地区和（或）人群，按统一的监测方案连续地开展监测。最典型的是艾滋病哨点监测（E对ABCD错），即选择有代表性的地区和艾滋病相关高危人群，按照统一的监测方案和检测试剂，连续开展定点、定时、定量的HIV抗体检测，同时收集监测人群与艾滋病传播相关的高危行为信息，从而获得不同地区、不同人群HIV感染状况和行为危险因素及变化趋势的资料。